下列哪项不是健康咨询的基本模式
A. 评估
B. 教育
C. 安排随访
D. 达成共识
E. 劝告

正确答案：B。教育

解析：健康咨询的基本模式（“5A模式”）是由医务人员在临床场所为患者提供健康咨询的五个基本的步骤，包括：①评估（Ask/Assess）；②劝告（Advise）；③达成共识（Agree）；④协助（Assist）；⑤安排随访（Arrange）。掌握“干预基本模式及烟草行为干预”知识点。